皮部红棕色，有数处嵌入木部的饮片是
A. 木通
B. 川木通
C. 通草
D. 大血藤
E. 鸡血藤

正确答案：D。大血藤

解析：本题考查的是大血藤饮片的性状鉴别。皮部红棕色，有数处嵌入木部的饮片是大血藤（D对）。大血藤：【性状鉴别】饮片呈类椭圆形的厚片。外表皮灰棕色、粗糙。切面皮部红棕色，有数处向内嵌入木部，木部黄白色，有多数导管孔，射线呈放射状排列。气微，味微涩。木通（A错）：【性状鉴别】饮片呈圆形、椭圆形或不规则形片。外表皮灰棕色或灰褐色。切面射线呈放射状排列，髓小或有时中空。气微，味微苦而涩川木通（B错）：【性状鉴别】饮片呈类圆形厚片，切面边缘不整齐，残存皮部黄棕色，木部浅黄棕色或浅黄色，有黄白色放射状纹理及裂隙，其间密布细孔（导管），髓部较小，类白色或黄棕色，偶有空腔。气微，味淡。通草（C错）：【性状鉴别】饮片呈圆形的厚片或小段，表面有银白色光泽。髓部中空或有半透明的薄膜，体轻，质松软，有弹性。气微，味淡。鸡血藤（E错）：【性状鉴别】药材呈椭圆形、长矩圆形或不规则的斜切片。栓皮灰棕色，有的可见灰白色斑块，栓皮脱落处显红棕色。质坚硬。切面木部红棕色或棕色，导管孔多数；韧皮部有树脂状分泌物呈红棕色至黑棕色，与木部相间排列呈数个同心性椭圆形环或偏心性半圆形环；髓部偏向一侧。气微，味涩。